患者，男性，28岁，3天前出现高热，体温39.9℃，胸痛，咳嗽，咯痰；胸片后前位右上肺野呈大片状密度增高阴影，下缘整齐，以水平裂为界，上缘模糊不清，在实变的阴影中间见到含气支气管影。考虑是
A. 大叶性肺炎
B. 支气管肺炎
C. 右上肺不张
D. 肺结核
E. 中心型肺癌

正确答案：A。大叶性肺炎

解析：大叶性肺炎，炎症可累及整个肺叶，也可呈肺段分布。X线表现：充血期无明显变化，或仅见局限性肺纹理增粗、增深。实变期时肺野可见均匀性密度增高的片状阴影，病变范围呈肺段性或大叶性分布，在大片密实阴影中常可见到透亮的含气支气管影。消散期可见实变阴影逐渐减退，由均匀性变为不均匀性，并出现散在斑片状影，大小不等，继而可见到增粗的肺纹理，最后可完全恢复正常。X线片上病灶影完全吸收，往往比临床症状消失为晚（A对）。支气管肺炎的X线表现：早期表现为肺纹理增粗，增多，然后随着病情的进展，可能会出现斑点状或斑片状阴影。严重者，斑点状、斑片状会逐渐增大，成为斑片状阴影，融合成大片，甚至整个肺段都会波及（B错）。肺不张的小叶呈缩小改变，密度均匀性的增高，相邻肺叶的叶间裂呈向心性的移位，纵隔及肺门可以有不同程度的向患侧移位；邻近的肺叶可以见到代偿性的过度充气表现（C错）。原发型肺结核的典型表现有3个X线征。①原发浸润②淋巴管炎③肺门、纵隔淋巴结肿大（D错）中心型肺癌，如肿瘤同时向腔外生长或（和）伴肺门淋巴结转移，则可在肺门形成肿块发生于右上叶的支气管肺癌，肺门部肿块和右肺上叶不张连在一起可形成横行“S”状的下缘。有时肺癌发展迅速、较大，其中心可发生坏死而形成空洞，多见于鳞癌，表现为内壁不规则的偏心性空洞（E错）。